患者，女，28岁，因“多汗、心慌、消瘦、易怒半月余”就诊，实验室检查显示FT₄和FT₃均升高，TSH降低，甲状腺Ⅱ度肿大，心率92次/分，诊断为“甲状腺功能亢进症”（简称“甲亢”）。给予甲巯咪唑片10mg，一日3次，盐酸普萘洛尔片10mg，一日3次。患者1月后复查，FT₃和FT₄恢复正常，但出现膝关节疼痛。患者用药期间，有妊娠计划，药师的合理化建议是
A. 甲状腺激素水平恢复正常后即可停药准备妊娠
B. 可以妊娠，选择适当的抗甲状腺药物以最小剂量维持治疗
C. 不可停药妊娠，应手术切除甲状腺后再准备妊娠
D. 妊娠期间应将甲状腺功能维持在正常下限
E. 停用甲巯咪唑，换用小剂量碘剂治疗

正确答案：B。可以妊娠，选择适当的抗甲状腺药物以最小剂量维持治疗

解析：本题考查甲巯咪唑片用药注意事项。患者用药期间，有妊娠计划，药师的合理化建议是可以妊娠，选择适当的抗甲状腺药物以最小剂量维持治疗（B对）。抗甲状腺药可透过胎盘屏障并引起胎儿甲状腺功能减退及甲状腺肿大，甚至在分娩时造成难产、窒息。但是有明显甲亢的妊娠妇女如不加以控制，对母亲及胎儿皆有不利影响，因此对患甲亢的妊娠妇女宜采用丙硫氧嘧啶最小有效剂量（AC错），维持甲状腺功能在正常上限（D错）。妊娠及哺乳期妇女、婴幼儿禁用碘制剂（E错）。